Q-T间期代表的是
A. 心房去极化的时间
B. 心室去极化的时间
C. 心房和心室去极化的时间总和
D. 心房去极化开始至心室去极化的时间
E. 心室去极化和复极化所需时间总和

正确答案：E。心室去极化和复极化所需时间总和

解析：Q-T间期代表的是心室去极化和复极化所需时间总和（E对）。心房去极化的时间（A错）为P波时长。心室去极化的时间（B错）为QRS波时长。心房和心室去极化的时间总和（C错）为P波时长加上QRS波时长。心房去极化开始至心室去极化的时间（D错）为PR间期。